Hill准则中，判断因果关系存在与否的特异条件包括
A. 时间顺序、生物学合理性
B. 时间顺序、存在关联
C. 存在关联、结果的一致性
D. 存在关联、特异性
E. 生物学合理性、实验证据

正确答案：B。时间顺序、存在关联

解析：本题考查Hill准则。Hill准则中，判断因果关系存在与否的特异条件包括：时间顺序、存在关联（B对ACDE错）。